29岁妇女，痛经3年，婚后2年未孕，妇检：子宫鸭卵大，质硬，后位，活动受限，后穹窿可触及多个小结节，未经治疗，应首选哪种治疗方法
A. 甲基睾丸素长期应用
B. 高效孕激素类药物
C. 保留生育功能手术
D. 克罗米酚
E. HCG诱发排卵

正确答案：B。高效孕激素类药物

解析：育龄期妇女，痛经3年，婚后2年未孕（子宫内膜异位症的典型临床表现），妇检：子宫鸭卵大（提示子宫不大），质硬，后位，活动受限，后穹隆可触及多个小结节（提示病变累及直肠后间隙），根据患者的临床症状及体征，考虑最可能的诊断为子宫内膜异位症，该患者年轻且有生育要求，应首选高效孕激素类药物治疗（B对），其目的是降低垂体促性腺激素水平，并直接作用于子宫内膜和异位内膜，导致内膜萎缩和经量减少，若药物治疗无效则行保留生育功能手术（C错），甲基睾丸素（A错）主要用于治疗更年期阴道出血，克罗米酚（D错）主要功效是促排卵，主要用于治疗无排卵型不孕症，HCG诱发排卵（E错）对该病的治疗没有疗效。